紫菀的功效是
A. 清肺化痰
B. 消痰利水
C. 泻肺平喘
D. 化痰止咳
E. 纳气平喘

正确答案：D。化痰止咳

解析：本题考查的是紫菀的功效。紫菀的功效是化痰止咳（D对）。紫菀：【功效】润肺下气，化痰止咳。马兜铃：【功效】清肺化痰（A错），止咳平喘，清肠疗痔。昆布：【功效】消痰软坚，利水（B错）消肿。葶苈子：【功效】泻肺平喘（C错），利水消肿。磁石：【功效】镇惊安神，平肝潜阳，聪耳明目，纳气平喘（E错）。